下列说法哪项不正确
A. 营养不良分为消瘦型、水肿型及过渡型3种
B. 夸希奥科多发生于断奶期后以谷物喂养为主的婴儿
C. 恶性营养不良常有全身脏器萎缩、皮肤毛发病变及继发感染
D. 水肿型营养不良患儿能量供给充足而蛋白质供给相对不足
E. 极度消瘦患儿系长期能量及各种营养素缺乏所致

正确答案：D。水肿型营养不良患儿能量供给充足而蛋白质供给相对不足

解析：本题考查营养不良的相关内容。水肿型营养不良患儿是由于蛋白质供给严重不足（D错，为本题正确答案）导致浮肿，严重者可以出现胸水、腹水、颜面浮肿等。营养不良分为消瘦型、水肿型及过渡型3种（A对）；夸希奥科多发生于断奶期后以谷物喂养为主的婴儿（B对）；恶性营养不良常有全身脏器萎缩、皮肤毛发病变及继发感染（C对）；极度消瘦患儿系长期能量及各种营养素缺乏所致（E对）。